骨髓像巨核细胞明显减少最常见于
A. 缺铁性贫血
B. 再生障碍性贫血
C. 巨幼细胞性贫血
D. 特发性血小板减少性紫癜
E. 溶血性贫血

正确答案：B。再生障碍性贫血